白薇的性能特点不包括
A. 苦泄降
B. 咸入血
C. 寒清凉
D. 甘能和
E. 兼透散

正确答案：D。甘能和

解析：本题考查白薇的性能特点。白薇的性能特点不包括甘能和（D错，为本题正确答案）。白薇【性能特点】本品苦泄降（A对），咸入血（B对），寒清凉（C对），兼透散（E对），略补益，入肝、胃、肺经。清透并具，以清为主，清中兼透，略兼益阴。既退虚热，又凉血热，兼除烦；既透营分热，又透阴分伏热，还透解表热；并能解热毒而疗疮，利小便而通淋，解蛇毒而愈蛇伤。清泄透利而不伤阴，略兼益阴而不敛邪，凡虚热、血热、热毒皆宜，兼表亦可。